脉沉细而软者，称为
A. 结脉
B. 促脉
C. 代脉
D. 微脉
E. 弱脉

正确答案：E。弱脉

解析：该题考查常见脉象的特征。弱脉的特点为脉沉细无力而软（E对）。